某建筑工人，从高处坠落，腰背挫伤，双下肢弛缓瘫痪，来院急诊。检查见腰部不能活动，双侧腹股沟以下感觉运动及反射消失。X线显示胸12椎体压缩性骨折。入院后2小时其双下肢功能逐渐恢复。该患者的脊髓伤可能是
A. 脊髓震荡
B. 脊髓出血
C. 脊髓水肿
D. 脊髓受压
E. 马尾损伤

正确答案：A。脊髓震荡

解析：患者腰背有高处坠落受伤史，腰部不能活动，双下肢弛缓性瘫痪、双侧腹股沟以下感觉运动及反射消失（提示可能有脊髓损伤），X线显示T12椎体压缩性骨折，入院后2小时其双下肢功能逐渐恢复，结合患者病史、临床表现和影像学检查，该患者最可能的诊断为胸椎骨折伴脊髓震荡（A对）。脊髓震荡（P688）指脊髓受到强烈震荡后而发生超限抑制，脊髓功能处于生理停滞状态，表现为损伤平面以下感觉、运动及反射消失，经过数小时至数天，感觉和运动逐渐恢复。脊髓出血（B错）所致的感觉运动损伤通常是永久性的。脊髓水肿（C错）可由病毒、炎症、外伤所致，表现为脊髓平面以下的各种功能障碍、截瘫或不完全截瘫，不会在短期内恢复正常。脊髓受压（D错）多见于有移位的脊柱骨折，脊髓由于受到碎骨片压迫而导致瘫痪，移去压迫物脊髓功能可恢复正常，但压迫时间过长，脊髓会发生坏死、软化、萎缩或瘢痕形成，则瘫痪难以恢复。马尾神经损伤（E错）主要表现为损伤平面以下弛缓性瘫痪，且一般为不可逆性，不会在短期内恢复正常。